不适宜学龄前儿童的卫生保健措施是
A. 定期体格检查
B. 培养良好卫生习惯
C. 预防弱视、斜视
D. 预防意外伤害
E. 生殖卫生教育

正确答案：E。生殖卫生教育

解析：本题考查学龄前儿童的保健要点。女童月经初潮、男童首次遗精是青春期性发育的重要标志，因此对青春期儿童的生殖卫生教育（E错，为本题正确答案）有特别重要的意义。学龄前儿童的保健措施：（1）入学前期教育；（2）入学前准备；（3）保证充足营养；（4）预防感染与事故：集体机构中儿童为预防传染性疾病，应培养良好的卫生习惯（B对），预防儿童发生溺水、触电等意外伤害（D对）；（5）合理安排生活；（6）定期体格检查（A对）；（7）视力、听力、口腔保健：预防弱视、斜视（C对）、中耳炎、龋齿等；（8）疾病筛查。